下列有关尖牙卡环，说法正确的
A. 支持、固位作用较好
B. 固位、稳定作用较好
C. 支持、稳定作用较好
D. 固位作用较差
E. 支持作用较差

正确答案：A。支持、固位作用较好

解析：本题考查局部义齿固位体。尖牙卡环：专门用于尖牙上。设近中切支托，卡环由切支托顺舌面近中切缘嵴向下，至舌隆突，方向上转，沿舌面远中边缘嵴至远中切角，反折至唇面，卡环臂在唇面进入近中倒凹区。此卡环的支持、固位作用较好（A对）。